职业健康监护档案包括
A. 健康检查资料和生物监测资料
B. 健康检查资料和流行病学资料
C. 劳动卫生调查资料和健康检查资料
D. 健康检查资料和实验室检查资料
E. 生产环境监测资料和健康检查资料

正确答案：E。生产环境监测资料和健康检查资料